患者，女，30岁。虚热时发，虚烦失眠，自汗，形瘦气短，咽干舌燥，大便难，舌质暗红，脉虚数。治疗应选用
A. 炙甘草汤
B. 归脾汤
C. 补中益气汤
D. 竹叶石膏汤
E. 当归六黄汤

正确答案：A。炙甘草汤

解析：患者虚热时发，虚烦失眠，自汗，形瘦气短，咽干舌燥，大便难，舌质暗红，脉虚数。属虚劳肺痿证，方用炙甘草汤。方中炙甘草补气健脾，复脉益心；生地黄滋阴补血，充脉养心。人参、大枣益心，气补脾气，以资气血生化之源；阿胶、麦冬、麻仁滋心阴，养心血，充血脉。桂枝、生姜辛行温通，温心阳，通血脉，清酒煎服，温通血脉，以行药力（A对）。归脾汤方证因思虑过度，劳伤心脾，气血亏虚所致。本方为治疗心脾气血亏虚的常用方（B错）。补中益气汤方证因饮食劳倦，损伤脾胃，以致脾胃气虚，清扬下陷所致。本方为补气升阳，甘温除热的代表方（C错）。竹叶石膏汤方证乃热病后期，余热未清，气津两伤，胃气不和所致。本方为治疗热病后期，余热未清，气津耗伤的常用方（D错）。当归六黄汤方为治阴虚火旺所致盗汗的常用方（E错）。